无潮热，口和齿润，小便清长，夜卧安静，属
A. 心善
B. 肝善
C. 脾善
D. 肺善
E. 肾善

正确答案：E。肾善

解析：无潮热，口和齿润，小便清长，夜卧安静，属肾善（E对）。心善为精神爽快，言语清亮，舌润不渴，寝寐安宁（A错）。肝善为身体轻便，不怒不惊，指甲红润，二便通利（B错）。脾善为唇色滋润，饮食知味，脓黄而稠，大便和润（C错）。肺善为声音响亮，不咳不喘，呼吸均匀，皮肤润泽（D错）。